关于生物利用度和生物等效性试验设计的错误表述是
A. 研究对象的选择条件为：年龄一般为18～40岁，体重为标准体重±10%的健康自愿受试者
B. 在进行相对生物利用度和生物等效性研究时应首先选择国内外已上市相同剂型的市场主导制剂为标准参比制剂
C. 采用双周期交叉随机试验设计，两个试验周期之间的时间间隔不应少于药物的10个半衰期
D. 整个采样期时间至少应为3～5个半衰期或采样持续到血药浓度为Cmax的1/10～1/20
E. 服药剂量一般应与临床用药一致，受试制剂和参比制剂最好为等剂量

正确答案：A。研究对象的选择条件为：年龄一般为18～40岁，体重为标准体重±10%的健康自愿受试者